牙周病最重要的临床表现之一是
A. 牙齿移位
B. 牙周溢脓
C. 口臭
D. 牙周袋形成
E. 牙龈肿胀、出血、疼痛

正确答案：D。牙周袋形成

解析：本题考查牙周病最重要的临床表现。牙周袋包括真性牙周袋和假性牙周袋。真性牙周袋指当患牙周炎时，结合上皮向根方增殖，其冠方部分与牙面分离形成的牙周袋。假性牙周袋指当患牙龈炎时，龈沟的加深是由于牙龈的肿胀和增生使龈缘位置向冠方移动，而结合上皮的位置并未向根方移动。牙周病是牙龈炎和牙周炎的总称，牙龈炎会有假性牙周袋，牙周炎有真性牙周袋，所以牙周袋形成（D对）是牙周病最重要的临床表现之一。牙齿移位（A错）是牙槽骨吸收引起的牙周炎的特征性表现。牙周溢脓（B错）一般在牙龈化脓感染时发生，较少见。口臭（C错）发生在口腔卫生不佳和有消化道等疾病的患者。牙龈肿胀、出血在牙龈炎和牙周炎均可出，牙周病一般无疼痛（E错）症状，牙龈出现急性坏死溃疡时才会出现疼痛症状。以上症状在一定的条件下出现，并不是牙周病最重要的临床表现。